Ⅱ度牙松动是指
A. 牙松动幅度在1mm以内
B. 牙松动幅度在0．5～lmm以内
C. 牙松动幅度在2～3mm以内
D. 牙松动幅度在1～3mm以内
E. 牙松动幅度在1～2mm以内

正确答案：E。牙松动幅度在1～2mm以内

解析：本题考查牙松动度。Ⅱ度牙松动是指牙松动幅度在1～2mm以内（E对）。临床上牙松动度的测量和记录常以牙的松动幅度计算：Ⅰ度松动：松动幅度不超过1mm；Ⅱ度松动：松动幅度为1～2mm；Ⅲ度松动：松动幅度大于2mm。